在肝十二指肠韧带内经行的有
A. 肝静脉
B. 肝门静脉
C. 肠系膜上静脉
D. 胃左静脉
E. 脾静脉

正确答案：B。肝门静脉

解析：肝门静脉（B对）在肝十二指肠韧带内经行，多由肠系膜上静脉和脾静脉在胰颈后面汇合而成。